女，55岁。恶心、呕吐、少尿6小时，呕吐量大，无口渴。2年前有腹部手术史。此时患者最可能出现的的水电解质紊乱是
A. 高渗性脱水
B. 稀释性低钠血症
C. 高钾血症
D. 低渗性缺水
E. 等渗性缺水

正确答案：E。等渗性缺水

解析：患者中年女性。恶心、少尿（等渗性缺水虽细胞外液的渗透压正常，但细胞外液量减少，所以导致少尿）6小时，呕吐，呕吐量大（引起消化液急性丧失），无口渴（等渗性缺水为水和钠成比例地丧失，因此血清钠仍在正常范围，细胞外液的渗透压也可保持正常，所以无口渴）。2年前有腹部手术史（可能发生肠粘连，引起肠梗阻），综上，患者最可能出现的水电解质紊乱是等渗性缺水（E对）（P12）。高渗性缺水（A错）主要由摄入水分不够或丧失水分过多引起。患者缺水高于失钠，细胞外液渗透压升高，有口渴（P11-P12）。稀释性低钠血症（B错），即水中毒。系机体摄入水总量超过了排水量，以致水分在体内潴留，引起血浆渗透压下降和循环血量增多，主要由各种原因所致的抗利尿激素分泌过多、肾功能不全，排尿能力下降或机体摄入水分过多导致（该患者缺少相关病因）（P13）。患者呕吐量大，导致钾大量丢失，可导致低钾血症（C错）（P13-P14）。低渗性缺水（D错）患者失钠多于缺水，细胞外液呈低渗状态，无口渴，主要由消化液的持续性丧失，如反复呕吐（该患者没有反复呕吐病史）所致，缺钠程度较轻时，机体代偿性减少抗利尿激素分泌，尿量增加，循环血容量严重减少时，机体将不再顾及渗透压的维持，使抗利尿激素分泌增加，出现少尿（该患者没有尿量增加的表现，只表现为少尿）（P11）。